Vc含量测定方法为
A. 碘量法
B. 非水溶液滴定法
C. 高效液相色谱法
D. 毛细管电泳法
E. 气相色谱法

正确答案：A。碘量法

解析：本题考查碘量法。Vc含量测定方法为碘量法（A对）。碘可做为氧化剂而被中强的还原剂还原，而维生素C还原性强，可直接用碘量法测定其含量。非水溶液滴定法（B错）包括非水碱量法和非水酸量法，非水碱量法适用于有机弱碱及其盐类，非水酸量法适用于有机弱酸及其盐类。高效液相色谱（C错）用于对试样的分析。毛细管电泳法（D错）用于分离样品组分。气相色谱法（E错）用于测试某一特定化合物的纯度以及对混合物中的各组分进行分离。